降低总胆固醇和低密度脂蛋白最明显的药物是
A. 烟酸
B. 多烯脂肪酸
C. 普罗布考
D. 乐伐他汀
E. 非诺贝特

正确答案：D。乐伐他汀

解析：A项烟酸：大剂量应用可以抑制肝脏合成TG以及抑制VLDL的分泌，而间接减少LDL水平，同时增加HDL水平。B项多烯脂肪酸：明显降低TG，但血浆TC和LDL水平可能升高。C项普罗布考：能降TC水平，并同时降低人的血浆LDL浓度，在降脂治疗中的地位尚确定。D项乐伐他汀：降低LDL，大剂量也能轻度降低TG。E项非诺贝特：对LDL升高无效，对TG，VLDL升高有效。掌握“抗动脉粥样硬化药”知识点。